含有1个手性碳的二氢吡啶类钙通道阻滞剂，用于高血压治疗的药物是
A. 硝苯地平
B. 苯磺酸氨氯地平
C. 盐酸氟桂利嗪
D. 盐酸维拉帕米
E. 盐酸地尔硫䓬

正确答案：B。苯磺酸氨氯地平

解析：本题考查苯磺酸氨氯地平。苯磺酸氨氯地平（B对）是含有1个手性碳的二氢吡啶类钙通道阻滞剂，用于高血压的治疗，其中4位碳原子具手性。硝苯地平（A错）结构对称，不含手性碳；盐酸氟桂利嗪（C错）是无手性碳的钙离子拮抗剂，临床主要用于治疗脑动脉硬化，脑出血；维拉帕米（D错）是含有1个手性碳的钙通道阻滞剂，可用于室上性心动过速的治疗；地尔硫䓬（E错）含2个手性碳。